预防刺激性气体所致肺水肿的关键是
A. 给氧
B. 注射强心剂
C. 早期足量皮质激素的应用
D. 控制感染
E. 镇咳、化痰

正确答案：C。早期足量皮质激素的应用